护肝片既能疏肝理气，又能
A. 健脾消食
B. 解表散热
C. 疏肝解郁
D. 疏肝清热
E. 消胀止痛

正确答案：A。健脾消食

解析：本题考查的是护肝片的功能。护肝片既能疏肝理气，又能健脾消食（A对）。护肝片【功能】疏肝理气，健脾消食。小柴胡颗粒【功能】解表散热（B错），疏肝和胃。解郁安神颗粒【功能】疏肝解郁（C错），安神定志。加味逍遥丸【功能】疏肝清热（D错），健脾养血。柴胡舒肝丸【功能】疏肝理气，消胀止痛（E错）。